丁香的功效是
A. 温肾助阳，温中降逆
B. 温肺化饮，止咳平喘
C. 暖肝散寒，除痹止痛
D. 温经通脉，行气消积
E. 温中散寒，杀虫止痒

正确答案：A。温肾助阳，温中降逆

解析：本题考查的是丁香的功效。丁香的功效是温肾助阳，温中降逆（A对）。丁香：【功效】温中降逆，温肾助阳。干姜：【性能特点】本品辛热温散。入脾、胃经，既祛脾胃寒邪，又助脾胃阳气，为温中祛寒之要药，无论实寒、虚寒证皆宜。入心经，能回阳通脉，常辅助附子以回阳救逆，治亡阳欲脱。入肺经，能温肺化饮，治寒饮咳喘常投（B错）。花椒：【功效】温中止痛，杀虫止痒（E错）。功能为暖肝散寒，除痹止痛（C错）或温经通脉，行气消积（D错）的中药，2022年考试指南未明确说明。